善于治疗心痛呕血咯血疔疮的腧穴是
A. 外关
B. 郄门
C. 内关
D. 孔最
E. 间使

正确答案：B。郄门

解析：郄门是手厥阴心包经腧穴，主治急性心痛、心悸、心烦、胸痛等心胸病证（B对）；咯血、呕血、衄血等热性出血证；疗疮；癫痫。外关主治热病；头痛、目赤肿痛、耳鸣、耳聋等头面五官病证；瘰疬；胁肋痛；上肢痿痹不遂（A错）。内关主治心痛、胸闷、心动过速或过缓等心系病证；胃痛、呕吐、呃逆等胃腑病证；中风，偏瘫，眩晕，偏头痛；失眠、郁证、癫狂病等神志病证；肘、臂、腕挛痛（C错）。孔最主治鼻衄、咯血、咳嗽、气喘、咽喉肿痛等肺系病证；肘臂挛痛（D错）。间使主治心痛、心悸等心系病证；胃痛、呕吐等胃热病证；热病，疟疾；癫狂痫；腋肿，肘、臂、腕挛痛（E错）。